指浅屈肌
A. 止于第2-4指中节指骨
B. 完全包裹于腱鞘内
C. 屈远侧指骨间关节
D. 肌腱穿经腕管
E. 表面有掌深弓横越

正确答案：D。肌腱穿经腕管

解析：指浅屈肌止于第2～5指中节指骨，而非第2～4指中节指骨（A错），故其肌腱穿经腕管（D对），屈近侧指骨间关节，而非远侧指骨间关节（C错）。